急性肾小球肾炎水肿的主要机制为
A. 肾小球滤过率下降，水钠潴留
B. 低蛋白血症
C. 毛细血管通透性增加
D. 继发性醛固酮增多症
E. 抗利尿激素增加

正确答案：A。肾小球滤过率下降，水钠潴留

解析：急性肾小球肾炎病变主要累及肾小球，以内皮细胞及系膜细胞增生为主要表现，急性期可伴有中性粒细胞和单核细胞浸润。病变严重时，增生和浸润的细胞可压迫毛细血管袢使管腔狭窄或闭塞。因此导致肾小球滤过率下降，水钠潴留，体液瘀滞于体内形成水肿（A对）。急性肾小球肾炎常为轻度蛋白尿，血浆白蛋白正常或轻度降低，低蛋白血症（B错）可为急性肾小球肾炎水肿的机制之一，但并不是最主要的机制，其是肾病综合征水肿的主要机制。毛细血管通透性增加（C错）是过敏性水肿的主要机制。急性肾小球肾炎时，醛固酮、抗利尿激素分泌减少，因此继发性醛固酮增多症（D错）、抗利尿激素增加多（E错）均不是急性肾小球肾炎水肿的机制。